川芎可用于
A. 肺热咳嗽
B. 肠燥便秘
C. 痰气闭塞心窍之癫痫
D. 斑疹色暗
E. 风寒头痛

正确答案：E。风寒头痛

解析：本题考查的是川芎的主治病证。川芎可用于风寒头痛（E对）。川芎：【主治病证】（1）月经不调，痛经，闭经，难产，产后瘀阻腹痛。（2）胸痹心痛，胁肋作痛，肢体麻木，跌打损伤，疮痈肿痛。（3）头痛，风湿痹痛。虎杖：【主治病证】（1）湿热黄疸，淋浊，带下。（2）水火烫伤，疮痈肿毒，毒蛇咬伤。（3）闭经，痛经，癥瘕，跌打损伤，风湿痹痛。（4）肺热咳嗽（A错）。（5）热结便秘。（6）肝胆及泌尿系结石症。桃仁：【主治病证】（1）血滞闭经、痛经，产后腹痛，癥瘕，跌打肿痛。（2）肺痈，肠痈。（3）肠燥便秘（B错）。（4）咳喘。郁金：【主治病证】（1）胸腹胁肋胀痛或刺痛，月经不调，痛经，癥瘕痞块。（2）热病神昏，癫痫发狂（C错）。（3）血热之吐血、衄血、尿血，妇女倒经。（4）湿热黄疸，肝胆或泌尿系结石症。红花：【主治病证】（1）血滞闭经、痛经，产后恶露不尽。（2）胸痹心痛，癥瘕积聚，跌打肿痛。（3）斑疹色暗（D错）（配清热凉血解毒药）。